患者戴用全口义齿1周后，自诉义齿易松动。如果病人说明仅在打哈欠时义齿易掉，应该检查什么，除了
A. 义齿边缘伸展
B. 义齿磨光面形态
C. 后堤区是否合适
D. 系带是否让开
E. 义齿是否稳定

正确答案：E。义齿是否稳定

解析：本题考查全口义齿固位不良的情况及原因。义齿仅在打哈欠时义齿易掉（E错，为本题的正确答案）是义齿固位不良的表现。如果义齿平时固位良好，仅在打哈欠时义齿易掉，可能的原因有：1.是由于基托边缘过长、过厚，唇、颊、舌系带区缓冲不够，影响系带活动，此时应检查义齿边缘伸展（A对）、系带是否让开（D对）；2.义齿磨光面外形不好，此时应检查义齿磨光面形态（B对）；3.义齿后堤区过长过厚，影响软组织活动，此时应检查后堤区是否合适（C对）。